将一定量的药材提取物加适宜的辅料密封于球形、椭圆形或其他形状的软质囊材中制成的药剂，称为
A. 滴丸
B. 胶丸
C. 硬胶囊剂
D. 浓缩丸
E. 乳剂

正确答案：B。胶丸